梅毒螺旋体能够感染的宿主为
A. 只能感染人
B. 感染动物
C. 感染人和动物
D. 感染猩猩
E. 感染灵长类动物

正确答案：A。只能感染人

解析：本题考查梅毒螺旋体能够感染的宿主。苍白密螺旋体苍白亚种俗称梅毒螺旋体，是人类梅毒病原体，因此梅毒螺旋体只能感染人（A对BCDE错）。由致病性钩端螺旋体感染引起的钩端螺旋体病是全球流行的人畜共患病。